一般认为与氟中毒的发病机理无关的因素是
A. 氟与钙结合沉降在骨中
B. 抑制肾小管对磷的重吸收
C. 激活骨磷酸化酶
D. 使恒齿的牙釉质钙化变色
E. 使牙釉质疏松多孔

正确答案：C。激活骨磷酸化酶

解析：本题考查氟中毒的发病机理。地方性氟中毒是由于一定地区的环境中氟元素过多，而致生活在该环境中的居民经饮水、食物和空气等途径长期摄入过量氟所引起的以氟骨症和氟斑牙为主要特征的一种慢性全身性疾病。与其发病机理有关的因素有：氟与钙结合沉降在骨中（A对）；抑制肾小管对磷的重吸收（B对）；使恒齿的牙釉质钙化变色（D对）；使牙釉质疏松多孔（E对）。氟中毒的发病机理与激活骨磷酸化酶（C错，为本题正确答案）无关。